第6颈脊髓节平对
A. 第4颈椎
B. 第5颈椎
C. 第6颈椎
D. 第7颈椎
E. 第l胸椎

正确答案：B。第5颈椎

解析：下颈髓节段约平对同序数椎骨的上1块椎骨，因此第6颈脊髓节平对第5颈椎（B对）；第5颈脊髓节平对第4颈椎（A错）；第7颈脊髓节平对第6颈椎（C错）；第8颈脊髓节平对第7颈椎（D错）；第2胸髓平对第1胸椎（E错）。